关于病毒性肝炎对妊娠的影响错误的认识是
A. 妊娠早期病毒性肝炎可使流产、胎儿畸形发生率增高
B. 妊娠晚期合并急性病毒性肝炎可使妊娠期高血压疾病发生率增高
C. 会增加新生儿患病率及死亡率的危险
D. 乙型肝炎可通过产后传播传给胎儿
E. 甲型肝炎可以通过胎盘传给胎儿

正确答案：E。甲型肝炎可以通过胎盘传给胎儿